腺垂体分泌的激素是
A. 皮质醇
B. 泌乳素
C. 肾上腺素
D. 血管加压素
E. 促甲状腺激素释放激素

正确答案：B。泌乳素

解析：腺垂体分泌多种激素，如生长激素、催乳素（B对）、促甲状腺激素、促肾上腺皮质激素、卵泡刺激素和黄体生成素。皮质醇（A错）为肾上腺皮质分泌的激素。肾上腺素（C错）为肾上腺髓质分泌的激素。血管加压素（D错）为下丘脑释分泌，在神经垂体中储存。促甲状腺激素释放激素（E错）为下丘脑分泌的激素。